生脉散与四君子汤的药物组成均含有的药物是
A. 茯苓
B. 附子
C. 白术
D. 甘草
E. 人参

正确答案：E。人参

解析：生脉散组成为人参、麦冬、五味子（生脉麦冬五味参，保肺清心治暑淫，气少汗多兼口渴，病危脉绝急煎斟），四君子汤组成为人参、白术、茯苓、甘草（四君子汤中和义，参术茯苓甘草比）（E对）